手厥阴心包经与手少阳三焦经的交接部位是
A. 目外眦
B. 目内眦
C. 无名指端
D. 鼻旁
E. 口角旁

正确答案：C。无名指端

解析：手厥阴心包经与手少阳三焦经交接于无名指端（C对）。手少阳三焦经与足少阳胆经在目外眦交接（A错）。手太阳小肠经与足太阳膀胱经的交接部位是目内眦（B错）。手阳明大肠经与足阳明胃经在鼻旁交接（D错）。口角旁为干扰选项（E错）。